仰卧位时，吸入性肺脓肿好发于
A. 上叶后段或下叶背段
B. 下叶后基底段
C. 右上叶前段或后段
D. 右下叶后基底段
E. 肺尖部

正确答案：A。上叶后段或下叶背段

解析：吸入性肺脓肿是由病原体经口、鼻、咽腔吸入致病。正常情况下，吸入物经气道黏液-纤毛运载系统、咳嗽反射和肺巨噬细胞可迅速清除。但当有意识障碍如在麻醉、醉酒、药物过量、癫痫、脑血管意外时，或由于受寒、极度疲劳等诱因，全身免疫力与气道防御清除功能降低，吸入的病原菌可致病。吸入性肺脓肿，仰卧位时，好发于上叶后段或下叶背段（A对）；坐位时好发于下叶后基底段（BD错）；右侧卧位时，则好发于右上叶前段或后段（C错）；肺尖部（E错）为继发性肺结核的好发部位。